霍乱的重要预防措施是
A. 接种疫苗
B. 对密切接触者进行检疫
C. 管好食品
D. 隔离患者
E. 开窗通风

正确答案：D。隔离患者

解析：隔离患者是霍乱的重要预防措施（D对）。疫苗接种是预防流感的基本措施（A错）。常用减毒活疫苗或灭活疫苗，在疫苗毒株与流行毒株一致的情况下预防效果肯定。对密切接触者进行检疫和隔离患者属于控制传染源（B错）。开窗通风属于切断传播途径（E错）。